玉米中呈结合型且不易被人体利用的维生素是
A. 维生素A
B. 烟酸
C. 维生素C（抗坏血酸）
D. 维生素D
E. 维生素E

正确答案：B。烟酸

解析：本题考查玉米中呈结合型且不易被人体利用的维生素。玉米中的烟酸（B对ACDE错）呈结合型，不易被人体利用，经加碱加工后可转化为游离型烟酸。